虚劳患者，口干唇燥，不思饮食，大便燥结，甚则干呕，呃逆，面色潮红，舌红干少苔，脉细数。其证候是
A. 肺阴虚
B. 脾胃阴虚
C. 肝阴虚
D. 肾阴虚
E. 心阴虚

正确答案：B。脾胃阴虚

解析：津亏不能上承，故口干唇燥；脾胃阴虚，运化失常，故不思饮食；肠胃失于滋润，则大便燥结。若阴亏较甚，胃气失于和降，则致干呕，呃逆；面色潮红，舌红干少苔，脉细数，均为阴虚内热之象，故诊断为脾胃阴虚证（B对）。肺阴虚证，其证候为干咳，咽燥，甚或失音，咯血，潮热，盗汗，面色潮红，舌红少津，脉细数(A错)。肝阴虚证，其证候为头痛，眩晕，耳鸣，目干畏光，视物不明，急躁易怒，或肢体麻木，筋惕肉瞤，面潮红，舌干红，脉弦细数（C错）。肾阴虚证，其证候为腰酸，遗精，两足痿弱，眩晕，耳鸣，甚则耳聋，口干，咽痛，颧红，舌红，少津，脉沉细（D错）。心阴虚证，其证候为心悸，失眠，烦躁，潮热，盗汗，或口舌生疮，面色潮红（E错）。